患者寒战，高热，伴蓝绿色脓痰，诊断为肺炎，X线显示弥漫性支气管炎，可能感染的病菌是
A. 肺炎链球菌
B. 金黄色葡萄球菌
C. 铜绿假单胞菌
D. 肺炎克雷伯杆菌
E. 大肠埃希菌

正确答案：C。铜绿假单胞菌

解析：患者寒战、高热，伴有蓝绿色脓痰（为铜绿假单胞菌肺炎的特征性痰液表现），X线显示弥漫性支气管炎，根据其临床表现和体征，考虑诊断为铜绿假单胞菌肺炎，故其致病菌为铜绿假单胞菌（C对）。肺炎链球菌（A错）肺炎起病急，有寒战、高热、咳铁锈色痰、胸痛，X线显示肺叶或肺段实变，无空洞，也可伴有胸腔积液征。金黄色葡萄球菌（B错）肺炎，起病急，有寒战、高热、脓血痰、气急、毒血症症状，严重时会发生休克，X线显示肺叶或小叶浸润，早期空洞，脓胸，可见液气囊腔。肺炎克雷伯杆菌（D错）肺炎，起病急，有寒战、高热、全身衰竭、咳砖红色胶冻状痰，X线显示肺叶或肺段实变，蜂窝状脓肿，叶间隙下坠。大肠埃希菌肺炎（E错），表现为原有慢性病，发热、脓痰、呼吸困难，X线显示支气管肺炎，脓胸等表现。